按照《非处方药专有标识管理规定（暂行）》，负责制定公布非处方药专有标识的机构是
A. 国家药品监督管理部门
B. 国家工商行政管理部门
C. 国家标准化行政主管部门
D. 国家出版管理部门
E. 国家知识产权管理部门

正确答案：A。国家药品监督管理部门

解析：本题考查非处方药专有标识管理。《非处方药专有标识管理规定（暂行）》中规定：国家药品监督管理局（A对）负责制定、公布非处方药专有标识及其管理规定。